龋病的人群分布特征不包括
A. 年龄
B. 性别
C. 城乡
D. 民族
E. 时间

正确答案：E。时间

解析：本题考查龋病的人群分布特征。龋病的人群分布特征不包括时间（E错，为本题的正确答案）。1.龋病的流行特征：（1）地区分布；（2）时间分布；（3）人群分布。2.龋病的人群分布特征：（1）年龄（A对）：龋病患病随年龄而变化，在人的一生之中，乳牙、年轻恒牙和老年人牙龈退缩后的恒牙易感龋病。（2）性别（B对）：关于性别与龋病的关系，目前尚无明确的定论，大多数调查显示乳牙患龋率男性略高于女性，而恒牙患龋率女性略高于男性。（3）城、乡（C对）：在发展中国家，一般城市居民的患龋率高于农村。（4）民族（D对）：在一个国家内，不同民族之间患龋情况也不同，这是由于饮食习惯、宗教、人文、地理环境等不同所致。